患者，女，31岁。人工流产术后3周，阴道出血时多时少，色暗红，有时夹血块，腹痛。B超提示：宫腔内回声不均。首先应考虑的诊断是
A. 子宫穿孔
B. 术后子宫内膜炎
C. 子宫收缩欠佳
D. 吸宫不全
E. 漏吸

正确答案：D。吸宫不全

解析：患者为年轻女性，人工流产术后3周，阴道出血时多时少，色暗红，有时夹血块，可考虑为吸宫不全，且腹痛B超提示：宫腔内回声不均，有助于诊断，故首先应考虑的诊断为吸宫不全（D对）。漏吸 确定为宫内妊娠，术中未能吸到胚胎及绒毛，主要是因胚囊过小，子宫过度屈曲或子宫畸形造成（E错）。子宫穿孔 妊娠子宫，尤其是哺乳期子宫柔软，剖宫产后妊娠子宫有瘢痕，子宫过度倾屈或畸形等，施术者的操作技术不佳均易致子宫穿孔。器械进入宫腔突然出现"无底"感觉，或其深度明显超过检查时子宫的大小，提示子宫穿孔，应立即停止手术（A错）。